药用部位是果实的药材有
A. 补骨脂
B. 金樱子
C. 菟丝子
D. 蛇床子
E. 女贞子

正确答案：A、B、D、E。补骨脂；金樱子；蛇床子；女贞子

解析：本题考查的是中药材的药用部位。药用部位是果实的药材有补骨脂（A对）、金樱子（B对）、蛇床子（D对）、女贞子（E对）。补骨脂：【来源】为豆科植物补骨脂的干燥成熟果实。金樱子：【来源】为蔷薇科植物金樱子的干燥成熟果实。蛇床子：【来源】为伞形科植物蛇床的干燥成熟果实。女贞子：【来源】为木犀科植物女贞的干燥成熟果实。菟丝子（C错）：【来源】为旋花科植物南方菟丝子或菟丝子的干燥成熟种子。